下列哪项不是月经先期气虚证的临床特点
A. 月经量多
B. 月经色淡
C. 月经质稀
D. 舌淡，脉弱
E. 月经提前7天

正确答案：E。月经提前7天

解析：月经先期是指月经周期提前7天以上，甚至10余日一行，连续3个周期以上者（E错，为本题正确答案）。月经先期气虚证分为脾气虚证和肾气虚证，脾气虚。脾气虚，统血无权，冲任不固，故月经提前而量多，肾气虚，封藏失司，冲任不固，故月经提前，经量增多（A对）。脾气虚火衰，血失温煦，则经色淡，质清晰，肾气不足，肾阳虚弱，血失温煦，则经色淡黯，质清晰（BC对）。舌淡，脉弱是脾气虚型月经先期的临床表现（D对）。